最能反映小叶性肺炎的病变特征的是
A. 病变累及肺小叶范围
B. 病灶多位于背侧和下叶
C. 病灶相互融合或累及全叶
D. 支气管化脓性炎
E. 细支气管及周围肺泡化脓性炎

正确答案：E。细支气管及周围肺泡化脓性炎

解析：小叶性肺炎是主要由化脓性细菌引起，以肺小叶为病变单位的化脓性炎，病变常以细支气管为中心，双肺散在分布，以背侧和下叶较多。随着病情进展，病变也可累及周围肺泡，故本题选择E选项最为恰当。病情严重者，也可见病灶相互融合，甚至累及全叶。